药源性疾病的治疗原则包括
A. 停用致病药物
B. 加快致病药物排出
C. 使用拮抗剂
D. 调整治疗方案
E. 对症治疗

正确答案：A、B、C、D、E。停用致病药物；加快致病药物排出；使用拮抗剂；调整治疗方案；对症治疗

解析：本题考查药源性疾病的治疗原则。药源性疾病的处置和治疗措施包括：1.停用致病药物（A对）。2.排除致病药物（B对）。3.拮抗致病药物（C对）。4.调整治疗方案（D对）。5.对症治疗（E对）。